治疗性功能低下宜选
A. 党参
B. 甘草
C. 黄芪
D. 冬虫夏草
E. 何首乌

正确答案：D。冬虫夏草

解析：本题考查的是冬虫夏草的功效。治疗性功能低下宜选冬虫夏草（D对）。冬虫夏草：【功效】益肾补肺，止血化痰。党参（A错）：【功效】补中益气，生津养血。甘草（B错）：【功效】益气补中，祛痰止咳，解毒，缓急止痛，缓和药性。黄芪（C错）：【功效】补气升阳，益卫固表，托毒生肌，利水消肿。何首乌（E错）：【功效】补益精血，解毒，截疟，润肠通便。